据《伤寒论》原文“自利不渴者”属
A. 少阴病
B. 厥阴病
C. 太阴病
D. 霍乱
E. 阳明病

正确答案：C。太阴病

解析：自利为太阴病主症之一，乃因脾阳虚弱，运化失职，寒湿内盛，水湿下渗所致。因无热邪，仅是中焦脾胃阳虚，寒湿内停，且下利轻，津未伤，故口不渴（C对）。自利不渴不仅可与里热下利之口渴作鉴别，而且亦与少阴病“自利而渴”有别，是太阴寒湿下利的审证要点。